绝大多数微生物无法生长的水分活度（Aw）范围是
A. ＜0.60
B. ＜0.70
C. ＜0.80
D. ＜0.87
E. ＜0.90

正确答案：A。＜0.60